男，56岁，咳嗽、胸闷、憋气2天，持续不缓解。查体：左侧呼吸运动减低，叩诊呈鼓音，呼吸音明显减低。胸部X线片示左肺萎陷，压缩约90%。该患者最有效的治疗措施是
A. 呼吸机辅助呼吸
B. 低流量吸氧
C. 胸腔闭式引流
D. 胸腔穿刺排气
E. 解痉平喘

正确答案：C。胸腔闭式引流

解析：患者为老年男性，咳嗽、胸闷、憋气2天，持续不缓解，左侧呼吸运动减低，叩诊呈鼓音，呼吸音明显减低（为气胸的典型表现），胸部X线片示左肺萎陷，压缩约90%，根据其临床表现和辅助检查，可诊断为气胸，由于患者肺压缩约90%，压缩程度较重，先穿刺排气，然后再引流，因此最有效的治疗措施为胸腔闭式引流（C对）。呼吸机辅助呼吸（A错）为ARDS以及呼吸衰竭患者的治疗措施。对于稳定性小量气胸，首次发生的症状较轻的闭合性气胸，高浓度吸氧可加快胸腔内气体的吸收（B错）（P122）。胸腔穿刺排气（D错）适用于较小量气胸，肺萎缩小于20%，呼吸困难较轻，心肺功能尚好的闭合性气胸患者。解痉平喘（E错）用于支气管哮喘的治疗，但对于气胸的治疗效果不明显。